维A酸与过氧苯甲酰联合应用治疗寻常痤疮对，正确的用法是
A. 睡前应用维A酸凝胶或乳膏，晨起洗漱后应用过氧苯甲酰凝胶
B. 睡前应用过氧苯甲酰凝胶，晨起洗漱后应用维A酸凝胶或乳膏
C. 两药的凝胶或乳膏间隔2小时交替使用
D. 将两种药物的凝胶或乳膏充分混合后同时应用
E. 前额、颜面部应用维A酸凝胶或乳膏，胸背上部应用过氧苯甲酰凝胶

正确答案：A。睡前应用维A酸凝胶或乳膏，晨起洗漱后应用过氧苯甲酰凝胶

解析：本题考查痤疮治疗药的使用。维A酸与过氧苯甲酰联合应用时，在同一时间、同一部位应用有物理性配伍禁忌，应早晚交替使用，即夜间睡前应用维A酸凝胶或乳膏，晨起洗漱后应用过氧苯甲酰凝胶（A对B错）。如单独应用维A酸，初始时宜采用低浓度0.025%～0.03%制剂；耐受后应用0.05%～0.1％制剂。与有光敏感性作用的药物合用有增加光敏感的危险。